即能产生抗体又能提呈抗原的免疫细胞是
A. B淋巴细胞
B. 树突状细胞
C. NK细胞
D. 巨噬细胞
E. T细胞

正确答案：A。B淋巴细胞

解析：既能产生抗体又能提呈抗原的免疫细胞是B淋巴细胞（A对）。T淋巴细胞（E错）的功能可以大概分成三种，即辅助功能、杀伤功能和抑制功能（E错）（八年制第二版医学免疫学P190）。树突状细胞（B错），NK细胞（C错），巨噬细胞（D错）均不能产生抗体。